能补肾阳、强筋骨的是
A. 杜仲
B. 海马
C. 蛤蚧
D. 刺五加
E. 巴戟天

正确答案：E。巴戟天

解析：本题考查的是巴戟天的功效。能补肾阳、强筋骨的是巴戟天（E对）。巴戟天：【功效】补肾阳，强筋骨，祛风湿。杜仲（A错）：【功效】补肝肾，强筋骨，安胎。海马（B错）：【功效】补肾助阳，活血散结，消肿止痛。蛤蚧（C错）：【功效】补肺气，定喘嗽，助肾阳，益精血。刺五加（D错）：【功效】补气健脾，益肾强腰，养心安神，活血通络。